当某种诊治决策对病人利害共存时，要求临床医师保证最大善果和最小恶果的医学伦理学原则是
A. 患者自主
B. 有利患者
C. 为社会主义现代化建设服务
D. 严谨审慎
E. 双方协商解决

正确答案：B。有利患者